正常骨盆的形态是
A. 骨盆的入口平面和中骨盆平面呈横椭圆形，出口平面呈纵椭圆形
B. 骨盆的入口平面和出口平面呈纵椭圆形，中骨盆平面呈横椭圆形
C. 骨盆的入口平面和中骨盆平面呈纵椭圆形，出口平面呈两个不同平面的三角形
D. 骨盆的入口平面呈横椭圆形，中骨盆平面呈纵椭圆形，出口平面呈两个不同平面的三角形
E. 骨盆的入口及出口平面呈椭圆形，中骨盆平面呈纵椭圆形

正确答案：D。骨盆的入口平面呈横椭圆形，中骨盆平面呈纵椭圆形，出口平面呈两个不同平面的三角形

解析：本题考查正常骨盆的形态。正常骨盆的形态是骨盆的入口平面呈横椭圆形，中骨盆平面呈纵椭圆形，出口平面呈两个不同平面的三角形（D对ABCE错）。